职业肿瘤的预防原则
A. 控制和管理职业性致癌因素
B. 对致癌剂的限制和使用定出规程
C. 健全医学监护制度
D. 加强控烟宣传
E. 以上全是

正确答案：E。以上全是

解析：本题考查职业肿瘤的预防原则。职业性肿瘤的预防，应针对致癌因素采取相应的措施，或将其危险度控制在最低水平。对化学物质，尤其是新的化学物质，应加强登记管理制度，建立筛检化学物致癌性的体系和灵敏的方法，在化学物进入生产或流通领域前对其安全性进行准确的预测。对于已经使用的化学物质，通过人群流行病学调查研究，积累资料，提供线索，获得有效的证据。对致癌物采取严格管理措施，必须建立致癌物的管理登记制度。病因控制应重视对职业性致癌因素最主要的协同致癌因子即吸烟的控制（E对ABCD错）。